涡轮钻拔牙有以下特点，其中错误的是
A. 无振动
B. 创伤较大
C. 手术视野清楚
D. 手术时间短
E. 术后并发症减少

正确答案：B。创伤较大

解析：本题考查涡轮钻拔牙的优点。涡轮钻拔牙有以下特点，其中错误的是创伤较大（B错，为本题的正确答案）。涡轮机拔牙基本无振动（A对），相比锤凿法创伤较小；配有自动喷水系统，拔牙时，自动喷水可将血液和碎屑冲出，配合吸引器，及时吸净血液，可使术野更清晰（C对）；由于涡轮机切割效率高，手术时间相对较短（D对）；同时避免了锤凿所致的骨折和颞下颌关节损伤术后并发症（E对）。